用于鉴别香豆素内酯环的显色反应是
A. 三氯化锑反应
B. 异羟肟酸铁反应
C. 盐酸锌粉反应
D. 四氢硼钠反应
E. 三氯化铁反应

正确答案：B。异羟肟酸铁反应

解析：本题考查异羟肟酸铁显色反应。异羟肟酸铁反应（B对）由于香豆素类具有内酯环，在碱性条件下可开环，与盐酸羟胺缩合成异羟肟酸，然后再在酸性条件下与三价铁离子络合成盐而显红色。甾体母核的颜色反应，三氯化锑反应（A错）可用于纸色谱或薄层色谱的显色。盐酸-镁粉（或锌粉）反应（C错）是鉴别黄酮类化合物最常用的颜色反应。四氢硼钠（钾）反应（D错）在黄酮类化合物中，NaBH₄对二氢黄酮类化合物专属性较高，可与二氢黄酮类化合物反应产生红色至紫色。三氯化铁反应（E错），多数黄酮类化合物因分子中含有酚羟基，故可产生阳性反应，但一般仅在含有氢键缔合的酚羟基时，才呈现明显的颜色。